与胸椎横突肋凹相关连的结构是
A. 肋头
B. 肋颈
C. 肋沟
D. 肋角
E. 肋结节

正确答案：E。肋结节

解析：在横突末端前面，有横突肋凹与肋结节相关节（E对）。